关于可可豆脂的说法，错误的是
A. 可可豆脂在常温下为黄白色固体，可塑性好
B. 可可豆脂具有多晶型
C. 可可豆脂不具有吸水性
D. 可可豆脂在体温下可迅速融化
E. 可可豆脂在10～20℃时易粉碎成粉末

正确答案：C。可可豆脂不具有吸水性

解析：本题考查栓剂。可可豆脂具有吸水性，每100g可可豆脂可以吸水20～30g（C错，为本题正确答案）；可可豆脂在常温下为黄白色固体（A对）；具有多晶型（B对）；其熔点在30℃至35℃，在体温下可迅速融化（D对）；在10～20℃时易碎成粉末（E对）。